心的节律冲动正常传导路径为
A. 窦房结→心房肌→房室结→结间束→His束→浦氏网
B. 窦房结→结间束→房室结→His束→左右束支→浦氏网
C. 房室结→His束→结间束→窦房结→左右束支→浦氏网
D. 心房肌→窦房结→房室结→结间束→左右束支→浦氏网
E. 以上都不对

正确答案：B。窦房结→结间束→房室结→His束→左右束支→浦氏网

解析：窦房结→结间束→房室结→His束→左右束支→浦氏网（B对）为心的节律冲动正常传导路径。